输血后7-14天发生的输血并发症是
A. 非溶血性发热性输血反应
B. 过敏反应
C. 迟发性溶血反应
D. 细菌污染反应
E. 输血相关的急性肺损伤

正确答案：C。迟发性溶血反应

解析：迟发性溶血反应（C对）即延迟性溶血反应，指发生在输血后7～14天的溶血反应，表现为原因不明的发热、贫血、黄疸和血红蛋白尿。非溶血性发热性输血反应（P22）（A错）是最常见的早期输血并发症，多发生于输血开始后15分钟～2小时内。过敏反应（P22）（B错）多发生在输血数分钟后，也可在输血中或输血后发生。细菌污染反应（P23）（D错）输血后可立即出现发热，若细菌毒力强、数量多，甚至可以立即出现内毒素性休克和DIC。输血相关的急性肺损伤（P23）（E错）常发生在输血后1-6小时内。